急性浆液性根尖周炎的临床表现，哪项不对
A. 患牙有叩痛
B. 无全身症状
C. 患者不能明确指出患牙
D. 患牙咬合时感到不适，咬紧后反而不痛
E. 电活力大多无反应

正确答案：C。患者不能明确指出患牙

解析：本题考查急性浆液性根尖周炎的临床表现。急性浆液性根尖周炎患牙典型的咬合痛症状，患者不能明确指出患牙为急性牙髓炎的特点，非急性浆液性根尖周炎（C错，为本题的正确答案）。急性浆液性根尖周炎叩痛（+）～（++）（A对）。浆液期无明显全身症状，化脓期时，尤其为骨膜下脓肿和黏膜下脓肿，可有明显的全身症状（B对）。牙髓炎症破坏到根尖，形成根尖周炎时，牙髓已无活力，牙髓电活力测试无反应（E对）。由于根尖周组织的病变，因此咬合时感到不适，咬合的压力可暂时缓解局部血管充血的状态，因此咬紧后反而不痛（D对）。